变态反应可发生
A. 感染性休克
B. 过敏性休克
C. 低血容量性休克
D. 心源性休克
E. 神经源性休克

正确答案：B。过敏性休克

解析：过敏性休克（B对）是某些过敏体质的人可因注射某些药物（如青霉素）、血清制剂或疫苗后，甚至进食某些食物或接触某些物品（如花粉）后，发生1型超敏反应（即变态反应）而引起休克。感染性休克（A错）是细菌、病毒、真菌、立克次体等病原微生物的严重感染可引起休克。低血容量性休克（C错）是指机体血容益减少所引起的休克。常见病因为失血、失液、烧伤、创伤等。心源性休克（D错）是指由于心脏泵血功能障碍，心排血量急剧减少，使有效循环血量和微循环灌流量显著下降所引起的休克。神经源性休克（E错）是强烈的神经刺激 剧烈疼痛、脊髓损伤或高位脊髓麻醉、中枢镇静药过量可抑制交感缩血管功能，使阻力血管扩张，血管床容积增大，有效循环血量相对不足而引起休克。